以下关于咬肌间隙解剖特点的描述中，正确的是
A. 位于咬肌与下颌支之间
B. 前界为磨牙后区黏膜
C. 后界为腮腺
D. B+C
E. A+B+C

正确答案：E。A+B+C

解析：咬肌间隙位于咬肌与下颌支之间。前界为磨牙后区黏膜，后界为腮腺。掌握“面侧深区及颌面部各间隙的境界”知识点。